某女，30岁。既往有慢性关节炎史，妊娠6个月，不慎受凉，两膝关节酸痛而僵，久坐加重，活动或温暖减轻。宜选用的药是
A. 桑寄生
B. 萆薢
C. 防己
D. 千年健
E. 秦艽

正确答案：A。桑寄生

解析：本题考查的是桑寄生的主治病证。既往有慢性关节炎史，妊娠6个月，不慎受凉，两膝关节酸痛而僵，久坐加重，活动或温暖减轻。宜选用的药是桑寄生（A对）。桑寄生：【主治病证】（1）风湿痹证，腰膝酸痛。（2）肝肾虚损，冲任不固所致的胎漏，胎动不安。萆薢（B错）：【主治病证】（1）膏淋，白浊。（2）湿盛带下。（3）风湿痹痛。防己（C错）：【主治病证】（1）风湿痹痛，尤以热痹为佳。（2）水肿，腹水，脚气浮肿，小便不利。千年健（D错）：【主治病证】风寒湿痹，腰膝冷痛，下肢拘挛麻木。秦艽（E错）：【主治病证】（1）风湿热痹，风寒湿痹，表证夹湿。（2）骨蒸潮热。（3）湿热黄疸。